根据药品广告审查发布标准，印有“请按药品说明书使用或在药师指导下购买和使用”广告忠告语的药品为
A. 处方药
B. 非处方药
C. 放射性药品
D. 中药材
E. 中药饮片

正确答案：B。非处方药

解析：本题考查广告发布准则。根据药品广告审查发布标准，印有“请按药品说明书使用或在药师指导下购买和使用”广告忠告语的药品为非处方药（B对）。药品广告的内容应当以国务院药品监督管理部门核准的说明书为准。药品广告涉及药品名称、药品适应症或者功能主治、药理作用等内容的，不得超出说明书范围。药品广告应当显著标明禁忌、不良反应，处方药（A错）广告还应当显著标明“本广告仅供医学药学专业人士阅读”，非处方药广告还应当显著标明非处方药标识（OTC）和“请按药品说明书或者在药师指导下购买和使用。